男性，45岁，无痛性肉眼血尿3个月，IVP显示左肾盂内有充盈缺损，膀胱镜检见左侧输尿管口喷血，应考虑
A. 肾结核
B. 肾癌
C. 阴性结石
D. 肾盂癌
E. 肾炎

正确答案：D。肾盂癌